患者，女，28岁。左侧下颌第三磨牙近中阻生，拟拔除。麻醉时注射药量过大，导致患者发生麻药中毒，其兴奋型表现中不包括
A. 烦躁不安
B. 颤抖、恶心
C. 呕吐、气急
D. 血压下降
E. 多汗、多话

正确答案：D。血压下降

解析：本题考查中毒反应的表现。患者，女，28岁，拔除左侧下颌第三磨牙近中阻生，麻醉时注射药量过大，导致患者发生麻药中毒（中毒反应），其兴奋型表现中不包括的是血压下降（D错，为本题正确答案），应为血压上升。中毒反应是指单位时间内进人血液循环的局麻药量超过分解速度，血内浓度过高时出现的中毒症状，常因单位时间内注射麻药量过大，或局麻药被快速注入血管而造成。中毒反应可分为兴奋型与抑制型：兴奋型表现为烦躁不安（A对）、多汗多话（E对）、颤抖恶心（B对）、呕吐气急（C对）及血压上升，严重者出现抽搐、缺氧、发绀；抑制型则迅速出现脉搏细弱、血压下降、神志不清，随即呼吸心跳停止。局麻药中毒的早期典型症状之一是口周麻木。